患儿，7日。近日经常夜惊多汗，且抽搐2次，抽后意识清，进奶好，医生诊断为：维生素D缺乏性手足搐搦症。本病以下哪项不具备
A. 喉痉挛
B. 全身性抽搐
C. 助产式手，芭蕾舞足
D. 面神经征阳性
E. 婴儿期呈婴儿痉挛性发作

正确答案：E。婴儿期呈婴儿痉挛性发作

解析：本患儿已被明确诊断为维生素D缺乏性手足搐搦症。维生素D缺乏性手足搐搦症是由于维生素D缺乏而甲状旁腺又不能代偿，以致血中钙离子降低，神经肌肉兴奋性增高，出现惊厥、手足肌肉抽搐或喉痉挛等症状，以惊厥（B对）为最常见的发作形式，患儿常无发热或其他原因而突发的四肢抽动，两眼上窜，面肌震颤，神志不清，发作时间为数秒至数分钟左右，可数日发作1次，或1日发作数次，发作轻时仅有短暂的眼球上窜和面肌抽动，神志清楚。另外，还可见手足搐搦，常见于6个月以上的婴幼儿，突发性手足强直痉挛，双手腕部屈曲、手指伸直、拇指内收掌心（即助产式手），以及足部踝关节伸直，足趾同时向下弯曲（即芭蕾舞足）（C对）；还可见喉痉挛（A对），婴儿多见，喉部肌肉及声门突发痉挛，呼吸困难，严重者可发生窒息、发绀、严重缺氧甚至死亡；还可见出汗、睡眠不安、易惊哭等神经兴奋的隐匿症状。此外，在患儿不发作时，也可通过刺激神经肌肉引出以下体征：①面神经征阳性（D对）：以叩诊锤或手指尖轻击患儿颧弓与口角间的面颊部（第7颅神经孔处）可引起眼睑和口角抽动者为阳性，新生儿期可呈假阳性。②腓反射：以叩诊锤骤击膝下外侧腓神经处可引起向外侧收缩者即为腓反射阳性。③陶瑟氏征：以血压计袖带包裹上臂，使血压维持在收缩压和舒张压之间，5分钟之内该手出现痉挛状属阳性。婴儿期呈婴儿痉挛性发作可见于婴儿痉挛症（E错，为本题正确答案）。